“连续用药3天症状未缓解，应向执业医师咨询或及时去医院就诊”的剂型是
A. 滴耳剂
B. 滴眼剂
C. 滴鼻剂
D. 眼膏剂
E. 鼻用喷雾剂

正确答案：A、C。滴耳剂；滴鼻剂

解析：本题考查各种剂型的正确使用。“连续用药3天症状未缓解，应向执业医师咨询或及时去医院就诊”的剂型是滴耳剂（A对）、滴鼻剂（C对）。滴耳剂主要用于耳道感染或疾患。如果耳聋或耳道不通，不宜应用。耳膜穿孔者也不要使用滴耳剂。鼻腔又深义窄，所以滴鼻时应头往后仰，使药液尽量达到较深部位。另外，鼻黏膜比较娇嫩，滴鼻剂必须对黏膜没有或仅有较小的刺激。